根据《麻醉药品和精神药品管理条例》定点批发企业使用现金进行麻醉药品和精神药品交易的
A. 由药品监督管理部门取消其定点批发资格，并依照药品管理法的有关规定处罚
B. 由药品监督管理部门责令改正，给予警告，没收违法交易的药品，并处罚款
C. 由设区的市级人民政府卫生主管部门责令限期改正，给予警告
D. 由县级以上人民政府卫生主管部门给予警告，暂停其营业活动
E. 由药品监督管理部门责令限期改正，给予警告

正确答案：B。由药品监督管理部门责令改正，给予警告，没收违法交易的药品，并处罚款

解析：本题考察特殊药品管理。定点批发企业使用现金进行麻醉药品和精神药品交易的，将由药品监督管理部门责令改正，给予警告，没收违法交易的药品，并处罚款（B对）。